每克营养物质供能最高的是
A. 矿物质
B. 蛋白质
C. 膳食纤维
D. 糖类
E. 脂类

正确答案：E。脂类

解析：人体供能的主要物质是糖、脂肪、蛋白质，矿物质（A错）、膳食纤维（C错）不供能，糖（D错）的产热量为17.2KJ/g，蛋白质（B错）在体内氧化分解不完全，产热量为18.0KJ/g，脂质（E对）的产热量为39.8KJ/g。